在一项药物副作用发生情况的研究中
A. 对照组必须用药
B. 对照组使用安慰剂
C. 设立对照组会使研究者得出错误结论，特别在副作用发生率很低的情况下
D. 是否设立对照组取决于可能发生反应的种类
E. 是否设立对照组取决于研究对象的年龄

正确答案：B。对照组使用安慰剂

解析：本题考查安慰剂效应。安慰剂效应指病人虽然获得无效的治疗，但却“预料”或“相信”治疗有效，而让病患症状得到舒缓的现象。在一项药物副作用发生情况的研究中，病例组使用药物，对照组使用安慰剂（B对ACDE错）。